关于药物在肝功能不全患者药动学和药效学变化的说法，错误的是
A. 主要在肝内代谢清除的药物，生物利用度提高
B. 需要肝脏生物转化的前体药物，药效降低
C. 蛋白结合率高的药物，血中游离药物浓度增加
D. 首过消除明显的药物，药理作用维持时间缩短
E. 血胆汁酸和胆红素升高，血浆蛋白与药物结合的能力下降

正确答案：D。首过消除明显的药物，药理作用维持时间缩短

解析：本题考查药物在肝功能不全患者药动学和药效学变化。关于药物在肝功能不全患者药动学和药效学变化的说法，错误的是首过消除明显的药物，药理作用维持时间缩短（D错，为本题正确答案）。首过消除明显的药物，药理作用维持时间延长。对于某些肝脏高摄取的药物，如阿司匹林、普萘洛尔等，在肝脏摄取后由于生物转化速率降低，口服药物后大量原型药通过肝脏进入血液循环，导致血药浓度上升、生物利用度增强（A对）。另一方面，某些需要在体内代谢后才具有药理活性的前体药（如可待因、依那普利、环磷酰胺等）则由于肝脏的生物转化功能减弱，这些药物的活性代谢产物生成减少，使其药理效应降低（B对）。在肝脏疾病时，肝脏的蛋白质合成功能减退，血浆中白蛋白浓度下降，使药物的血浆蛋白结合率降低，血中结合型药物减少，而游离型药物增加（C对）。肝脏疾病患者血中胆汁酸、胆红素的含量升高时，其竞争性与蛋白质结合，结果使药物的蛋白结合率下降，血浆中游离型的药物浓度升高（E对）。